以下有关疾病对生长发育影响作用的描述，哪一项是不准确的
A. 绝大多数先天性、遗传性疾病对生长发育有明显不利影响
B. 寄生虫疾病容易导致营养不良、生长发育受阻
C. 长期低烧可影响体格生长发育
D. 心理性疾病也会影响生长发育
E. 疾病是否影响生长发育取决于病变累及的组织、器官和系统

正确答案：B。寄生虫疾病容易导致营养不良、生长发育受阻